其草酸盐不溶于水的是
A. 小檗碱
B. 麻黄碱
C. 伪麻黄碱
D. 东莨菪碱
E. 山莨菪碱

正确答案：B。麻黄碱

解析：本题考查的是生物碱盐的溶解性。其草酸盐不溶于水的是麻黄碱（B对）。生物碱盐一般易溶于水，可溶于甲醇、乙醇，难溶或不溶于亲脂性有机溶剂。生物碱在酸水中成盐溶解，调碱性后又游离析出沉淀，可利用此性质提取分离生物碱。某些生物碱盐难溶于水，如小檗碱（A错）盐酸盐、麻黄碱草酸盐等。